《麻醉药品和精神药品管理条例》规定，第二类精神药品零售企业销售第二类精神药品时，应当
A. 凭执业医师出具的处方，按规定剂量销售
B. 禁止无处方销售
C. 将处方保存二年备查
D. 禁止超剂量销售
E. 不得向未成年人销售

正确答案：A、B、C、D、E。凭执业医师出具的处方，按规定剂量销售；禁止无处方销售；将处方保存二年备查；禁止超剂量销售；不得向未成年人销售

解析：本题考查麻醉药品和精神药品零售规定。《麻醉药品和精神药品管理条例》规定，第二类精神药品零售企业销售第二类精神药品时，应当凭执业医师出具的处方，按规定剂量销售（A对）；禁止无处方销售（B对）；将处方保存二年备查（C对）；禁止超剂量销售（D对）；不得向未成年人销售（E对）。麻醉药品和精神药品零售规定：1.麻醉药品和第一类精神药品不得零售。除经批准的药品零售连锁企业外，其他药品零售企业不得从事第二类精神药品零售活动。2.第二类精神药品零售企业应当凭执业医师开具的处方，按规定剂量销售第二类精神药品，并将处方保存2年备查。零售第二类精神药品时，处方应经执业药师或其他依法经过资格认定的药学技术人员复核；第二类精神药品一般每张处方不得超过7日常用量，禁止超剂量或者无处方销售第二类精神药品。3.第二类精神药品零售企业不得向未成年人销售第二类精神药品。在难以确定购药者是否为未成年人的情况下，可查验购药者身份证明。4.罂粟壳，必须凭盖有乡镇卫生院以上医疗机构公章的医生处方配方使用，不准生用，严禁单味零售，处方保存3年备查。